病人最近数月一直耳闻人语声，讲“要抓他”，非常害怕，病人称：“家中有窃听器、摄像机，马路上有人跟踪，自己完全被控制了。”你认为该病人的症状主要是
A. 思维散漫
B. 被害妄想
C. 被控制感
D. 错觉
E. 关系妄想

正确答案：B。被害妄想